患者高血压史2年。平素心烦惊悸，健忘失眠。治疗应首选
A. 合谷
B. 间使
C. 神门
D. 内关
E. 灵道

正确答案：C。神门

解析：神门为心经输穴，心之原穴，主治心痛、心烦、惊悸、怔仲、健忘、失眠、痴呆、癫狂痫心与神志病证；高血压；胸胁痛。结合患者有高血压病，平素心烦惊悸，健忘失眠。辩证为心悸，心悸病位在心，“五脏有疾，当取十二原”，治疗应首选取心经原穴神门穴（C对）。合谷（A错）为大肠经原穴，主治：头面五官诸疾、外感病、闭经滞产；间使（B错）为心包经经穴，主治：心系疾患；热病疟疾；胃脘疾病；上肢痹症。内关（D错）为心包经络穴，主治：心系疾患；胃脘疾病；上肢痹症等。灵道（E错）为心经经穴，主治：心痛、肘臂挛痛。